由三尖瓣环、三尖瓣、腱索、乳头肌构成的是
A. 窦房结
B. 室间隔
C. 三尖瓣复合体
D. 左、右冠状动脉开口
E. 二尖瓣

正确答案：C。三尖瓣复合体

解析：三尖瓣复合体（C对）由三尖瓣环、三尖瓣、腱索、乳头肌构成。